对婴幼儿的血管瘤一般采用哪一种治疗方法
A. 激素治疗
B. 低温治疗
C. 硬化剂注射
D. 高温治疗
E. 观察，如发展迅速在进行干预治疗

正确答案：E。观察，如发展迅速在进行干预治疗

解析：血管瘤与脉管畸形的治疗应根据病损类型、位置及患者的年龄等因素来决定。目前的治疗方法有外科切除、放射治疗、激素治疗、低温治疗、激光治疗、硬化剂注射等。一般采用综合疗法。对婴幼儿的血管瘤应行观察，如发展迅速时，也应及时给予一定的干预治疗。掌握“血管瘤与脉管畸形”知识点。